是否去尽龋坏组织最重要的依据是
A. 患者的感觉
B. 牙本质的硬度和着色程度
C. 窝洞深度
D. 内窥镜观察
E. 温度刺激后的反应

正确答案：B。牙本质的硬度和着色程度

解析：本题考查去尽龋坏组织最重要的依据。临床上一般根据牙本质的硬度和着色两个标准来判断龋坏组织是否去净（B对）。浅龋去腐患者无感觉，深龋、中龋去腐时无论龋损是否去净，患者均感酸痛不适，不能根据患者的感觉来判断龋损是否去净（A错）。龋损程度越深所备窝洞深度越深，深龋备洞较深，但不一定能将腐质去净（C错）。内窥镜观察只能观察牙本质的颜色不能探查质地（D错）。无论龋损是否去净，温度刺激进入窝洞引起激发痛的疼痛程度相同（E错）。